膀胱癌最常见的组织类型是
A. 鳞癌
B. 腺癌
C. 移行细胞癌
D. 透明细胞癌
E. 乳头状癌

正确答案：C。移行细胞癌

解析：膀胱癌绝大多数来自上皮组织，其中移行上皮细胞癌占90%以上，为最常见的膀胱肿瘤组织类型（C对），其次是鳞癌（A错）和腺癌（B错），各占2%～3%；非上皮性性肿瘤较少1%～5%，多为横纹肌肉瘤（E错）。透明细胞癌（D错）为肾癌最常见的病理组织类型。